女性，47岁。左下后牙食物嵌塞不适3个月。无自发痛。口腔检查：左下7近中邻（牙合）面有龋洞，叩诊（-），探诊（±），无松动。按分类法所备洞形应属
A. I类洞
B. Ⅱ类洞
C. Ⅲ类洞
D. Ⅳ类洞
E. Ⅵ类洞

正确答案：B。Ⅱ类洞

解析：本题考查Black分类法。女性，47岁。左下后牙食物嵌塞不适3个月。无自发痛。口腔检查：左下7近中邻（牙合）面有龋洞，叩诊（-），探诊（±），无松动。按分类法所备洞形应属Ⅱ类洞（B对）。左下7近中邻（牙合）面有龋洞为后牙邻面的龋损，应制备Ⅱ类洞。Black分类法：1.Ⅰ类洞（A错）：所有牙面发育点隙裂沟的龋损所备成的窝洞。2.Ⅱ类洞：后牙邻面的龋损所备成的窝洞。3.Ⅲ类洞（C错）：前牙邻面未累及切角的龋损所备成的窝洞。4.Ⅳ类洞（D错）：前牙邻面累及切角的龋损所备成的窝洞。5.Ⅴ类洞：所有牙齿颊（唇）舌面颈1/3处的龋损所备成的窝洞。6.由于龋损部位的多样化，Black的分类法不能完全满足临床需要，有学者将前牙切嵴或后牙牙尖发生的龋损所备成的窝洞列为Ⅵ类洞（E错）。